某患者突然出现高热，乏力，伴有腓肠肌疼痛，眼结膜出血以及淋巴结肿大。印象诊断是钩体病。该病原体的主要传染源和储存宿主是
A. 鼠和犬
B. 猪和犬
C. 鼠和猪
D. 牛和马
E. 羊和牛

正确答案：C。鼠和猪

解析：某患者突然出现高热，乏力，伴有腓肠肌疼痛，眼结膜出血以及淋巴结肿大。印象诊断是钩体病。该病原体的主要传染源和储存宿主是鼠和猪（C对）。钩体病是钩端螺旋体病的简称，病原体为致病性钩端螺旋体，临床特点为高热、全身酸痛、乏力、球结合膜充血、淋巴结肿大和明显的腓肠肌疼痛，严重者可并发肺出血、黄疸、脑膜脑炎和肾功能衰竭等。钩体的动物宿主相当广泛，主要传染源和储存宿主是鼠类和猪。